丁卡因
A. 可用于浸润麻醉
B. 脂溶性低
C. 穿透力弱
D. 作用较普鲁卡因弱
E. 可用于表面麻醉

正确答案：E。可用于表面麻醉